一老年患者患肺癌脑转移晚期，并出现一系列并发症，目前处于昏迷期。患者家属向医院提出要求放弃治疗。下列对放弃治疗的实施程序错误的是
A. 首先经过医学专家的充分论证是否符合放弃治疗的条件
B. 向家属详细交代病情
C. 由患者家属提出
D. 由患者家属在医疗文书上签字
E. 医务人员应该规劝家属继续医治，毕竟是一条生命

正确答案：E。医务人员应该规劝家属继续医治，毕竟是一条生命

解析：为更好地解决放弃治疗的伦理难题，在临床中具体实施时应考虑以下程序：首先，要经过医学专家的充分论证。根据患者的病史、临床表现、治疗经过、结合各项客观检查，必要时请相关科室专家会诊，对患者的预后及生存质量进行科学的判断和评估，分析患者是否符合放弃治疗的条件；其次，要向患者（家属）详细交待病情。由专家向患者（家属）交代病情，详细说明患者的诊断结果、诊断依据、治疗效果、目前状况、预后及费用情况，务必让患者（家属）对患者病情有全面的认识和理解，以便做出真实、自愿、有效的选择；再次，由患者（家属）提出并签字。在患者（家属）完全理解病情并做出放弃治疗的选择后，由患者（家属）在医疗文书上签字；最后，终止治疗措施。履行放弃治疗的医疗文书后，由经治医师根据医疗文书的内容实施放弃治疗措施。掌握“临床治疗的伦理决策”知识点。